女，55岁。上腹胀痛8个月，突发剧痛2小时。查体：T36.5℃，P80次/分，R18次/分，BP120/80mmHg，消瘦、贫血貌，左锁骨上淋巴结肿大1.8cm×1.5cm，质硬，无压痛。双肺呼吸音清，未闻及干湿性啰音，心律齐，全腹肌紧张，上腹明显压痛、反跳痛。立位腹部X线平片可见膈下游离气体。下一步治疗最合理的术式为
A. 姑息性胃大部切除术
B. 胃造瘘术
C. 胃癌根治术
D. 穿孔修补术
E. 胃空肠吻合术

正确答案：A。姑息性胃大部切除术

解析：女，55岁（胃癌好发年龄）。上腹胀痛8个月（消化道症状），突发剧痛2小时。查体：T36.5℃，P80次/分，R18次/分，BP120/80mmHg（血压降低），消瘦、贫血貌（慢性贫血），左锁骨上淋巴结肿大1.8cm×1.5cm（淋巴转移），质硬，无压痛。双肺呼吸音清，未闻及干湿性啰音，心律齐，全腹肌紧张，上浮明显压痛、反跳痛。立位腹部X线平片可见膈下游离气体（胃癌穿孔表现）。最可能的诊断为胃癌并发穿孔。该患者胃癌很可能已经浸润胃壁全层，分期晚，不适宜做胃癌根治术。胃癌姑息性手术是指原发灶无法切除，针对由于胃癌导致的梗阻、穿孔、出血等并发症状而作的手术，故该患者下一步治疗最合理的术式为姑息性胃大部切除术（A对）。